甲亢患者，给予他巴唑20mg，—日3次，在家中治疗。半个月后应到医院复查
A. 心率、心律
B. 心电图
C. 甲状腺大小
D. 白细胞计数
E. 突眼程度

正确答案：D。白细胞计数

解析：他巴唑治疗甲状腺功能亢进症的重要不良反应是粒细胞减少，往往突然发生且危及生命，可见于初始用药2～3个月内或减量过程中，故应用他巴唑治疗甲亢的患者，应定期检查白细胞计数（D对）。心率、心律（A错）、心电图（B错）、甲状腺大小（C错）、突眼程度（E错）均不会危及患者生命，故无需用药半月后复查。